可作为全口义齿人工牙下后牙排列参考标志的是
A. 上颌结节
B. 磨牙后垫
C. 切牙乳突
D. 远中颊角区
E. 颊棚区

正确答案：B。磨牙后垫

解析：本题考查无牙颌的解剖标志。可作为全口义齿人工牙下后牙排列参考标志的是磨牙后垫（B对）。上颌结节及远中颊角区为全口义齿的缓冲区（AD错）；磨牙后垫可作为下颌全口义齿后牙排列的标志；切牙乳突可以作为上颌全口义齿前牙排列的参考标志（C错）；颊棚区为全口义齿的主承托区（E错）。